对于存在单侧或双侧游离端缺隙或较长的非游离缺隙，记录上下颌关系使用
A. 蜡形
B. 蜡堤
C. 蜡基托
D. 蜡（牙合）
E. 蜡托

正确答案：B。蜡堤

解析：用蜡堤记录上下颌关系。对于存在单侧或双侧游离端缺隙，或较长的非游离缺隙。在口内有余留牙能位置正确的垂直距离和牙尖交错（牙合），但在模型上上下颌对合不稳定者。掌握“局部义齿颌位关系记录及人工牙选择”知识点。